右心室左心室增大，肺血多，主动脉结缩小的先心病是
A. 动脉导管未闭
B. 法洛四联症
C. 肺动脉狭窄
D. 房间隔缺损
E. 室间隔缺损

正确答案：E。室间隔缺损

解析：右心室、左心室增大，肺血多，主动脉结缩小是室间隔缺损（E对）的X线检查主要表现。动脉导管未闭（A错）大量分流导致心胸比率增大，左心室增大，心尖向下扩张，左心房亦轻度增大。肺血增多，肺动脉段突出。主动脉结正常或凸出。法洛四联症（B错）典型者前后位心影呈“靴状”，即心尖圆钝上翘，肺动脉段凹陷，上纵隔较宽，肺门血管影缩小，肺血减少。肺动脉狭窄（C错）严重时主要表现为右心室和右心房扩大。狭窄后的肺动脉扩张为本病的特征性改变。房间隔缺损（D错）心脏外形轻至中度增大，以右心房及右心室为主，肺动脉段突出，肺叶充血明显。